影响远曲小管、集合管排钾的调节因素是
A. 醛固酮
B. 细胞外液的钾浓度
C. 远曲小管的原尿流速
D. 酸碱平衡状态
E. 以上都是

正确答案：E。以上都是

解析：醛固酮（A对）可作用于远曲小管、集合管，使肾保钠排钾作用加强。细胞外液的钾浓度改变会引起肾小管上皮细胞内外跨膜电位的改变而影响其排钾量。远曲小管的原尿流速越快（C对），远曲小管、集合管排钾越多。酸碱平衡状态（D对）会导致细胞外液的钾浓度（B对，故E为本题正确答案）改变，最终引起远曲小管、集合管排钾的改变。